慢性细菌性痢疾迁延型是指病情迁延不愈，病程至少超过
A. 150天
B. 60天
C. 28天
D. 7天
E. 14天

正确答案：B。60天

解析：菌痢病情迁延不愈超过2个月（B对）以上者称作慢性菌痢，多与急性期治疗不及时或不彻底，细菌耐药或机体抵抗力下降有关，也常因饮食不当、受凉、过劳或精神因素等诱发。依据临床表现可分为以下三型：（1）慢性迁延型，急性菌痢发作后，迁延不愈，时轻时重。长期腹泻可导致营养不良、贫血、乏力等；（2）急性发作型，有慢性菌痢史，间隔一段时间又出现急性菌痢的表现，但发热等全身毒血症状不明显；（3）慢性隐匿型，有急性菌痢史，无明显临床症状，但粪便培养可检出志贺菌，结肠镜检可发现黏膜炎症或溃疡等病变（P180）。